一位38岁的男患者，右下67间牙龈反复肿胀半年，在以下病史中，哪一项最应想到
A. 饮食习惯
B. 是否嵌塞食物
C. 是否做过牙体治疗
D. 进食时是否加重
E. 是否偏侧咀嚼

正确答案：B。是否嵌塞食物

解析：本题考查食物嵌塞。患者为38岁的男患者，右下67间牙龈反复肿胀半年，首先应想到是否嵌塞食物（B对），因为食物嵌塞通常与牙齿的邻面接触区有关，若邻面接触不良，则食物碎块或纤维易在咬合压力的作用下嵌入邻间隙，导致牙龈肿胀、牙菌斑积聚甚至牙龈退缩及牙周袋的形成。在病史问诊时，还应想到饮食习惯（A错）；是否做过牙体治疗（C错），治疗是否完善，是否有充填体悬突，是否存在（牙合）创伤等；进食时是否加重（D错），咬硬物时是否加重等；是否偏侧咀嚼（E错），是否常用右侧咀嚼等，但这些均不是牙间牙龈肿胀时最先想到的病史。